具有补肾阳，益精血功效的药组是
A. 补骨脂，益智仁
B. 淫羊藿，巴戟天
C. 沙苑子，淫羊藿
D. 杜仲，补骨脂
E. 鹿茸，肉苁蓉

正确答案：E。鹿茸，肉苁蓉

解析：鹿茸性味甘咸性温，入肾经，禀纯阳之性，具生发之气，故能峻补肾阳，益精血；肉苁蓉甘温助阳，质润滋养，咸以入肾，能补肾阳，益精血，但其作用从容和缓，难求速效（E对）；补骨脂，益智仁都可以补肾阳，用于肾阳虚衰证，但两者都没有益精血的功效（A错）；淫羊藿，巴戟天两者都可以补肾阳，强筋骨，祛风湿，但两者都没有益精血的功效（B错）；沙苑子能补肾助阳，固精缩尿，养肝明目，淫羊藿可以补肾阳，强筋骨，祛风湿，但两者都没有益精血的功效（C错）；杜仲能补肝肾，强筋骨，安胎，补骨脂能温肾助阳，纳气平喘，温脾止泻，两者都没有益精血的功效（D错）。